患者，女，32岁。行经后小腹部绵绵作痛，喜按，月经色淡，量少。治疗应首选
A. 三阴交、中极、次谬
B. 足三里、太冲、中极
C. 丰隆、天枢、气穴
D. 阴陵泉、中极、阳陵泉
E. 三阴交、足三里、气海

正确答案：E。三阴交、足三里、气海

解析：该患者以行经后小腹部绵绵作痛为主症，故诊断为痛经。小腹部绵绵作痛，喜按，月经色淡，量少均为痛经虚证的表现。足三里能补益气血，气海能温阳冲任，三阴交健脾益气，调补肝肾，故选取足三里、气海、三阴交为主穴，以调补气血，温阳冲任（E对）。